饮料中乙醇含量不超过质量分数的
A. 0.02
B. 0.01
C. 0.005
D. 0.002
E. 0.001

正确答案：C。0.005

解析：本题考查饮料中的乙醇含量。饮料是经过定量包装的，供直接饮用或用水冲调饮用的，乙醇含量不超过质量分数为0.5%（C对ABDE错）的制品。